男，30岁，因上消化道出血6小时入院，输血过程中出现寒战、高热（39℃），尿量正常，诊断为
A. 过敏反应
B. 变态反应
C. 发热反应
D. 细菌污染反应
E. 溶血反应

正确答案：C。发热反应

解析：本例患者为青年男性，有消化道大出血的病史，输血过程中出现寒战、高热，体温为39℃，尿量正常，诊断为发热反应（C对）。输血并发的过敏反应（A错）临床表现为皮肤局限性或全身性瘙痒或荨麻疹，严重者可出现支气管痉挛、血管神经性水肿、会厌水肿，表现为咳嗽、喘鸣呼吸困难以及腹痛、腹泻等。输血并发的变态反应（B错）是过敏反应的常见类型。输血并发的细菌污染反应（D错）发生率较低，病人的反应程度依细菌污染的种类、毒力大小和输入的数量而异，轻者可仅有发热反应，严重者可出现感染性休克。输血并发的溶血反应（E错）是输血最严重的并发症，患者可立即出现呼吸困难、血压下降、心率加快等休克征象，同时出现血红蛋白尿和溶血性黄疸。